抗原是指能够刺激机体的免疫系统发生免疫应答
A. 产生抗体的物质
B. 产生致敏淋巴细胞的物质
C. 与相应的抗体在体内外特异性结合的物质
D. 与相应的致敏淋巴细胞在体内外特异性结合的物质
E. 具有免疫原性的分子都有抗原性，但具有抗原性的分子未必具有免疫原性

正确答案：E。具有免疫原性的分子都有抗原性，但具有抗原性的分子未必具有免疫原性

解析：本题考查抗原基本概念、分类、超抗原及佐剂。抗原可具有免疫原性和抗原性，前者指抗原刺激机体产生体液或细胞免疫应答的性质，后者指抗原被抗体（游离的或B细胞表面的）或TCR特异性结合的性质。具有免疫原性的分子都有抗原性，但具有抗原性的分子未必具有免疫原性（E对）。